患儿，2岁。纳差2个月，腹泻1周。平素食欲不振，挑食偏食，近日大便日行3~4次，食后作泻，面色萎黄，舌淡苔白，指纹淡红。治疗应首选
A. 熏洗法
B. 擦拭法
C. 割治疗法
D. 推拿疗法
E. 拔罐疗法

正确答案：D。推拿疗法

解析：题中患儿以纳差2个月，腹泻1周为主症，故诊断为泄泻。患儿平素食欲不振，挑食偏食致脾胃虚弱。脾胃虚弱，清阳不升，纳运无权，故食后作泻，大便日行3~4次，面色萎黄为脾虚不运，生化无源，气血不足所致，舌淡苔白，指纹淡红为脾虚之征，故辨为脾虚泻。熏洗法是利用中药的药液及蒸气熏蒸、擦洗人体外表的一种治法，用于发汗退热，透疹（A错）。擦拭法是用药液或药末擦拭局部的一种外治法，多用于口疮（B错）。割治疗法有调和气血，促进脾胃运化的作用，常用于治疗疳证和哮喘等病症（C错）。推拿疗法有促进气血循行、经络通畅、神气安定、脏腑调和的作用，能达到驱邪治病的目的。儿科临床常用于5岁以下小儿泄泻、腹痛、厌食、痿证、斜颈等疾病，题中患儿为泄泻脾虚泄，符合适应证（D对）。拔罐疗法有促进气血流畅、营卫运行、祛风散寒、舒筋止痛等作用，常用于肺炎喘嗽、哮喘、腹痛、遗尿等病症（E错）。